男，52岁。反复无痛肉眼血尿1个月。偶伴尿频、尿急。首先应考虑的疾病是
A. 膀胱肿瘤
B. 膀胱炎
C. 慢性前列腺炎
D. 膀胱结石
E. 前列腺增生

正确答案：A。膀胱肿瘤

解析：中年男性患者，无痛肉眼血尿（提示可能有泌尿系肿瘤），偶伴尿频、尿急，首先应考虑的疾病是膀胱肿瘤（A对）。膀胱炎（P537）（B错）主要表现为尿频、尿急、尿痛的膀胱刺激症状，常伴终末血尿。慢性前列腺炎（P541）（C错）常表现为尿频尿急尿痛，会阴部、下腹隐痛不适，性功能减退等，典型表现为尿道口滴白。膀胱结石（P562）（D错）的典型表现为排尿突然中断，疼痛放射至远端尿道及阴茎头部，伴排尿困难和膀胱刺激症状。前列腺增生（P553）（E错）以排尿困难为主要表现，一般不出现血尿。